我国制定药品检验方法的原则为
A. 准确、灵敏、简便、技术先进
B. 准确、灵敏、简便、快速
C. 准确、灵敏、技术先进、实际
D. 准确、灵敏、先进、经济合理
E. 准确、灵敏、快速、技术先进

正确答案：B。准确、灵敏、简便、快速

解析：本题考查药品检验方法的原则。我国制定药品检验方法的原则为准确、灵敏、简便、快速（B对）。